治疗胎位不正最常用的腧穴是
A. 合谷
B. 至阴
C. 三阴交
D. 太冲
E. 足三里

正确答案：B。至阴

解析：该题考查至阴穴的主治病证。至阴穴胎位不正，滞产；头痛，目痛；鼻塞，鼻衄（B对）至阴为纠正胎位不正的效穴。合谷穴主治头痛、目赤肿痛、齿痛、鼻衄、口眼歪斜、耳聋等头面五官诸疾；发热恶寒等外感病症，热病无汗或多汗；经闭、滞产等妇产科病症（A错）。三阴交穴主治肠鸣腹胀、腹泻等脾胃虚弱诸证；月经不调、带下、阴挺、不孕、滞产等妇产科病症；遗精、阳痿、遗尿等生殖泌尿系统疾患；心悸，失眠，高血压；下肢痿痹；阴虚诸证（C错）。太冲穴主治中风、癫狂痫、小儿惊风；头痛眩晕、耳鸣、目赤肿痛、口歪、咽痛等肝经风热病证；月经不调、痛经、闭经、崩漏、带下等妇科经带病证；黄疸、胁痛、腹胀、呕逆等肝胃病证；癃闭、遗尿；下肢痿痹，足跗肿痛（D错）。足三里主治胃痛、呕吐、噎嗝、腹胀、腹泻、痢疾、便秘等胃肠病证；下肢痿痹；癫狂等神志病；乳痈、肠痈等外科疾患；虚劳诸证，为强壮保健要穴（E错）。